根据面神经在颅外的行程及其与腮腺的关系，可显露面神经主干的参考标志是
A. 乳突前缘标志
B. 鼓乳裂标志
C. 外耳道软骨标志
D. 茎突标志
E. 以上均是

正确答案：E。以上均是

解析：显露面神经主干的参考标志有乳突前缘标志、鼓乳裂标志、外耳道软骨标志、茎突标志、二腹肌后腹标志。掌握“腮腺咬肌区、腮腺与面神经解剖关系”知识点。